下列哪种疾病不属于生物地球化学性疾病
A. 克山病
B. 氟斑牙
C. 黑脚病
D. 水俣病
E. 克汀病

正确答案：D。水俣病

解析：本题考查生物地球化学性疾病。生物地球化学性疾病是由于地壳表面化学元素分布的不均匀性，使某些地区的水和（或）土壤中某些元素过多或过少，当地居民通过饮水、食物等途径摄入这些元素过多或过少，而引起某些特异性疾病。主要包括：克山病（A对）、氟斑牙（B对）、黑脚病（C对）、克汀病（E对）等。水俣病（D错，为本题正确答案）是因食入被有机汞污染河水中的鱼、贝类所引起的甲基汞为主的有机汞中毒或是孕妇吃了被有机汞污染的海产品后引起婴儿患先天性水俣病，是有机汞侵入脑神经细胞而引起的一种综合性疾病。